阿司匹林的“溶液澄清度”检查系在碳酸氢钠试液中进行，目的是为了检查阿司匹林中的
A. 水杨酸
B. 醋酸
C. 醋酸苯酯
D. 乙酰水杨酸苯酯
E. 苯甲酸

正确答案：C、D。醋酸苯酯；乙酰水杨酸苯酯

解析：本题考查阿司匹林的“溶液澄清度”检查。阿司匹林的“溶液澄清度”检查系在碳酸氢钠试液中进行，目的是为了检查阿司匹林中的醋酸苯酯（C对）和乙酰水杨酸苯酯（D对）。阿司匹林的溶液澄清度检查主要是限制原料药中无羧基的特殊杂质的量。利用阿司匹林分子含羧基，可溶于碳酸钠试液，而杂质苯酚、醋酸苯酯、水杨酸苯酯及乙酰水杨酸苯酯等不溶的特性。阿司匹林中的游离水杨酸（A错）采用高效液相色谱法检查。醋酸（B错）与苯甲酸（E错）均含有羧基，易溶于碳酸钠溶液，不能用“溶液的澄清度”检查。